《野生药材资源保护管理条例》规定，属于濒临灭绝状态的稀有珍贵野生药材物种是
A. 梅花鹿
B. 厚朴
C. 黑熊
D. 银环蛇
E. 五味子

正确答案：A。梅花鹿

解析：本题考查野生药材物种。《野生药材资源保护管理条例》规定，属于濒临灭绝状态的稀有珍贵野生药材物种是梅花鹿（A对）。一级保护野生药材物种系指濒临灭绝状态的稀有珍贵野生药材物种。一级保护野生药材物种包括：虎骨、豹骨、羚羊角、鹿茸（梅花鹿）。黄芩（B错）为三级保护野生药材物种。厚朴（B错）、黑熊熊胆（C错）属于二级保护野生药材物种。五味子（E错）属于三级保护野生药材物种。银环蛇（D错）未列入国家重点保护野生药材名录。